确立以滋阴降火为肺痨治疗大法的医家是
A. 张仲景
B. 华佗
C. 孙思邈
D. 朱丹溪
E. 葛可久

正确答案：D。朱丹溪

解析：元·朱丹溪倡导“痨瘵主乎阴虚”之说，确立了滋阴降火的治疗大法（D对）。汉代张仲景在《金匮要略·虚劳病脉证并治》篇叙述了肺痨及其合并症（A错）。华佗的《中藏经·传尸》已经认识到肺痨具有传染的特点（B错）。唐代孙思邈的《千金要方》把“尸注”列入了肺脏病篇，明确病位主要在肺（C错）。葛可久的《十药神书》为我国治疗肺痨现存的第一部专著（E错）。